穿心莲的采收时间应为
A. 果实成熟期
B. 果实成熟前
C. 茎叶茂盛期
D. 幼苗期
E. 花开到顶、穗绿时

正确答案：C。茎叶茂盛期

解析：本题考查的是植物药的采收时间。穿心莲的采收时间应为茎叶茂盛期（C对）。全草类中药的采收时期：多在植物充分生长，茎叶茂盛时采割，如青蒿、穿心莲、淡竹叶等；有的则在花期采收（E错），如薄荷、益母草、荆芥、香薷等。全草类中药采收时大多割取地上部分，少数连根挖取全株药用，如金钱草、蒲公英等。茵陈有两个采收时间，春季幼苗高6～10cm时（D错）或秋季花蕾长成时。春季采的习称“绵茵陈”，秋季采的习称“花茵陈”。果实种子类中药的采收时期：一般果实多在自然成熟时（A错）采收，如瓜蒌、栀子、山楂等；有的在成熟经霜后采摘为佳，如山茱萸经霜变红，川楝子经霜变黄；有的采收未成熟的幼果（B错），如枳实、青皮等。若果实成熟期不一致，要随熟随采，过早肉薄产量低，过迟肉松泡，影响质量，如木瓜等。种子类药材需在果实成熟时采收，如牵牛子、决明子、芥子等。